骨关节炎最常累及的外周关节是
A. 远端指间关节、腕关节、膝关节
B. 腕关节、膝关节、髋关节
C. 远端指间关节、腕关节、肘关节
D. 远端指间关节、膝关节、髋关节
E. 远端指间关节、腕关节、髋关节

正确答案：D。远端指间关节、膝关节、髋关节

解析：骨关节炎是一种以软骨退行性改变和继发性骨质增生为特点的慢性关节疾病，最常累及的外周关节是远端指间关节、膝关节、髋关节（D对）等。